卡介苗、麻疹病毒疫苗属于
A. 灭活疫苗
B. 减毒活疫苗
C. 类毒素疫苗
D. 亚单位疫苗
E. 偶联疫苗

正确答案：B。减毒活疫苗

解析：目前应用的减毒活疫苗有卡介苗、麻疹病毒、脊髓灰质炎病毒、黄热病病毒、风疹病毒和腮腺炎病毒疫苗。掌握“免疫预防及免疫治疗”知识点。